7个月婴儿，吃鸡蛋发生过敏，提醒家长该儿童以后需慎用的疫苗是
A. 卡介苗
B. 乙肝疫苗
C. 脊髓灰质炎疫苗
D. 百白破联合疫苗
E. 麻疹疫苗

正确答案：E。麻疹疫苗

解析：本题考查疫苗接种的禁忌症。有过敏性史的人接种疫苗，常可引起过敏反应。在接种疫苗前应详细了解其过敏原，如疫苗含有该过敏原就不能接种疫苗，不含该过敏原的疫苗则可以接种。该婴儿7个月，吃鸡蛋发生过敏，主要是对其中的蛋白质过敏，因此一般不能打含蛋白质的疫苗。临床上常见含蛋白质的疫苗有麻疹疫苗（D对ABCE错）、风疹疫苗、腮腺炎三联疫苗等，这些疫苗的疫苗菌主要是在鸡蛋的尿膜腔中培养、繁殖，即使经过过滤、浓缩等工艺的处理，制备好的疫苗一般仍含有少量的蛋白质。